关于新生儿用药特点叙述正确的是
A. 新生儿的药物吸收较成人快
B. 新生儿的药物半衰期短
C. 药物在新生儿脑脊液中分布较少
D. 新生儿体表面积与体重之比较成人大
E. 新生儿局部用药透皮吸收较成人少

正确答案：D。新生儿体表面积与体重之比较成人大

解析：本题考查新生儿用药。关于新生儿用药特点叙述正确的是新生儿的体表面积与体重之比较成人大（D对）。新生儿的体表面积与体重之比较成人大，而且皮肤角化层薄，皮肤对外部用药吸收快而多（E错）。新生儿胃肠道正处于发育阶段，胃黏膜尚未发育完全，胃酸分泌最少，胃内酸度较低，胃排空慢，肠蠕动不规则，胆汁分泌功能不完全；上述因素使主要在胃内吸收的药物吸收较完全，而主要在十二指肠吸收的药物吸收减少（A错）。新生儿肝脏对多数药物具有足够的代谢能力，但某些酶系统对新生儿尚有不足，可使药物的代谢减慢，血浆半衰期延长（B错），容易出现蓄积中毒。新生儿血脑屏障未形成完全，故而药物易进入脑脊液（C错）。